男，40岁。因腹胀乏力纳差3天来诊。10年前体检发现HBsAg阳性，HBeAg阳性，ALT正常，口服中药断续治疗，有长期大量饮酒史。家中母亲及2个兄弟均为乙肝患者。查体：神志清楚，面色晦暗，无明显黄染，肝肋下未触及，脾肋下3cm。腹水征（+）。实验室检查：ALT50U/L，HBVDNA2×10⁵/ml。该患者最重要的治疗是
A. 对症治疗
B. 保肝治疗
C. 抗纤维化治疗
D. 免疫治疗
E. 抗病毒治疗

正确答案：E。抗病毒治疗

解析：40岁男性患者，腹胀乏力纳差3天（慢性肝炎一般表现），10年前体检发现HBsAg阳性，HBeAg阳性，ALT正常（乙肝病史），口服中药断续治疗，有长期大量饮酒史，家中母亲及2个兄弟均为乙肝患者（乙肝家族史）；查体：神志清楚，面色晦暗，无明显黄染，肝肋下未触及，脾肋下3cm。腹水征（+）（慢性肝炎临床表现）；实验室检查：ALT50U/L（正常参考值0～40U/L），HBV DNA2×10⁵拷贝/ml（﹥10⁵拷贝/ml），根据患者的病史、临床表现和实验室检查，患者为慢性乙型肝炎，且已达失代偿期，最重要的治疗是抗病毒治疗（E对），可抑制HBV复制，使肝病缓解，防止肝硬化及原发性肝癌的发生，提高生存率。对症治疗（A错）、保肝治疗（B错）、抗纤维化治疗（C错）、免疫治疗（D错）也属于慢性乙型肝炎的治疗的方法。